（132～135题共用题干）女，30岁。妊娠40周。临产12小时后在产钳助娩下分娩一4100g女婴。胎儿娩出后15分钟胎盘人工剥离取出，检查胎盘无异常，继之发生阴道大量流血。能说明处理有效的指标不包括
A. 心率增快
B. 血压上升
C. 子宫变硬
D. 尿量增加
E. 出血减少

正确答案：A。心率增快

解析：该患者产后大量出血，可导致循环血容量不足，甚至出现休克，休克代偿期时表现为血压降低，尿量减少，心率增快等，若正确处理后，将有效改善这些症状。按摩子宫、应用宫缩剂后，子宫收缩加强，子宫变硬（C对）且能迅速止血，出血减少（E对）；输血和补液之后，循环血容量增加，血压上升（B对）、尿量增加（D对）。心率增快（A错，为本题正确答案）是休克代偿期时表现，经有效治疗后，原有增快心率应变缓。